桂附地黄丸是治疗肾阳不足之腰膝酸冷、肢体浮肿的常见注意事项有
A. 孕妇慎用
B. 不宜长期服用
C. 肺热津伤者慎用
D. 阴虚内热消渴者慎用
E. 服药期间宜节制房事

正确答案：A、B、C、D、E。孕妇慎用；不宜长期服用；肺热津伤者慎用；阴虚内热消渴者慎用；服药期间宜节制房事

解析：本题考查的是桂附地黄丸的注意事项。桂附地黄丸是治疗肾阳不足之腰膝酸冷、肢体浮肿的常见注意事项有孕妇慎用（A对）、不宜长期服用（B对）、肺热津伤者慎用（C对）、阴虚内热消渴者慎用（D对）与服药期间宜节制房事（E对）。桂附地黄丸：【注意事项】孕妇、肺热津伤者、胃热炽盛者、阴虚内热消渴者慎用。治疗期间宜节制房事。因其含大热有毒的附子，故中病即止，不可过量服用或久服。服药期间，忌食生冷、油腻食物。